男，56岁。2年来表现为烦渴多食、多饮、多尿，体重下降，疲倦无力，注意力不集中，失眠，情绪低落，主动性差，反应迟钝。1周前出现兴奋不安，言语紊乱而住院。下列最有诊断价值的检查是
A. 尿常规
B. 血常规
C. T₃、T₄、TSH测定
D. 血糖测定
E. ACTH兴奋试验

正确答案：D。血糖测定

解析：患者为中年男性，有烦渴多食、多饮、多尿，体重下降（三多一少），伴中枢神经系统症状，考虑患者为糖尿病并神经系统并发症。1周前出现兴奋不安，言语紊乱（意识障碍），考虑合并有DKA（酮症酸中毒），最有诊断价值的检查是血糖测定（D对）。